女性，36岁。4个月来腹痛、腹泻，大便4～5次/日，为稀便，有时有粘液及少量血，抗生素治疗有效，多于劳累着凉及进食生冷食物后发作。体检未见异常，大便镜检WBC15～20/HP，RBC3～5/HP，有结肠阿米巴滋养体。本病人最可能的诊断是
A. 慢性阿米巴痢疾
B. 慢性菌痢
C. 肠结核
D. 慢性非特异性结肠炎
E. 结肠癌

正确答案：B。慢性菌痢